测定溶液的pH值时，酸度计使用的指示电极与比电极是
A. 银电极-氯化银电极
B. 铂-铂电极
C. 玻璃-饱和甘汞
D. 银-饱和甘汞
E. 铂-饱和甘汞

正确答案：C。玻璃-饱和甘汞

解析：本题考查酸度计。酸度计是由pH玻璃电极（指示电极）、甘汞电极（参比电极）（C对）和被测的试样溶液组成一个化学电池，与酸度计在零电流的条件下测量该化学电池的电动势。